对恋物癖者电击的方法属于
A. 家庭脱敏
B. 冲击疗法
C. 厌恶疗法
D. 松弛疗法
E. 自由联想

正确答案：C。厌恶疗法